某地调查80名男性，120名女性，患某疾病人数分别为10人和6人。则该地该疾病患病率的95%可信区间为
A. 0.0875±1.96Sp
B. 0.0875±2.58Sp
C. 0.08±1.96Sp
D. 0.08±1.645Sp
E. 0.08±2.58Sp

正确答案：C。0.08±1.96Sp